男，73岁。因脑梗死住院治疗1个月，病情基本稳定。3天前受凉后出现发热，咳嗽，咳红色胶冻状黏痰，查体：T38.7℃，呼吸急促，口唇发绀，右上肺叩诊浊音，可闻及支气管呼吸音和少量湿啰音，胸部X线片示右上肺大片状阴影，其中可见多个空洞。该患者最可能的诊断是
A. 真菌性肺炎
B. 肺炎链球菌肺炎
C. 肺炎克雷伯杆菌肺炎
D. 干酪性肺炎
E. 厌氧性肺炎

正确答案：C。肺炎克雷伯杆菌肺炎

解析：患者为老年男性，有脑梗的病史，3天前受凉后出现发热，咳嗽，咳红色胶冻性黏痰（克雷伯杆菌肺炎的特征性痰液），胸部X线片示右上肺大片状阴影，其中可见多个空洞，符合肺炎克雷伯杆菌肺炎临床特征（C对）。真菌性肺炎（P54）（A错）临床表现无特异性，诊断时必须综合考虑宿主因素、临床特征、微生物学检查和组织病理学资料，病理学诊断仍是肺真菌病的金标准。肺炎链球菌肺炎（P46）（B错）患者咳铁锈色痰，X线示肺叶或肺段实变，无空洞，可伴胸腔积液。干酪性肺炎（P68）（D错）是指以干酪性病变为主的浸润性肺结核，患者表现为肺结核症状，如低热盗汗等，X线影像呈大叶性密度均匀磨玻璃状阴影。厌氧性肺炎（E错）患者有吸入病史，高热、咳腥臭痰、毒血症症状明显，X线示支气管肺炎、脓胸、脓气胸，多发性肺脓肿。